医师在执业活动中，构成犯罪的应
A. 警告
B. 依法追究刑事责任
C. 吊销其执业证书
D. 责令暂停6个月以上1年以下
E. 责令暂停1年以上

正确答案：B。依法追究刑事责任

解析：医师在执业活动中，有下列行为之一的，由县级以上地方人民政府卫生行政部门给予警告或者责令暂停6个月以上1年以下执业活动；情节严重的，吊销其执业证书；构成犯罪的，依法追究刑事责任。掌握“医师执业规则及培训、考核及法律责任”知识点。